发于新生儿的丹毒，其病机多为
A. 风热毒蕴
B. 胎火蕴毒
C. 潮热毒蕴
D. 火毒炽盛
E. 肝经郁火

正确答案：B。胎火蕴毒

解析：新生儿者出现丹毒，多由胎热火毒所致（B对）。发于头面部者，多夹风热（A错）。发于下肢者，多夹湿热（C错）。丹毒为素体血分有热，加之皮肤黏膜破损、邪毒乘隙入侵，血热火毒郁阻肌肤所致（D错）。发于胸腹腰胯部者，多夹肝脾郁火（E错）。